下肢静脉血栓形成的患者不应该进行的治疗方式为
A. 双下肢按摩
B. 手术取栓
C. 下肢静脉滤网植入
D. 静脉注射肝素
E. 溶栓治疗

正确答案：A。双下肢按摩

解析：下肢静脉血栓形成患者不应该进行双下肢按摩（A错，为本题正确答案），因为按摩会导致栓子脱落。